根据《医疗机构药事管理暂行规定》，临床药学专业技术人员的主要职责不包括
A. 参与临床药物试验方案设计
B. 参与临床药物治疗方案设计
C. 对重点患者实施治疗药物监测
D. 收集药物安全性信息
E. 收集药物疗效信息

正确答案：A。参与临床药物试验方案设计